既与所研究的暴露因素有联系又与所研究的疾病有关的因子，称为
A. 混杂因子
B. 混杂作用
C. 病因假设
D. 联系
E. 因子

正确答案：A。混杂因子

解析：本题考查混杂因子的特点。混杂因子（A对BCDE错）的特点为：它一定是疾病的一个影响因素，又与所研究的因素有联系。